行于脉外具有摽急滑利之性的气是
A. 卫气
B. 宗气
C. 营气
D. 中气
E. 元气

正确答案：A。卫气

解析：卫气是行于脉外而具有保卫作用的气。卫气来源于脾胃运化的水谷精微。水谷之精化为水谷之气，其中剽悍滑利部分化生为卫气（A对）。宗气是由谷气与自然界清气相结合而积聚于胸中的气，属后天之气的范畴（B错）。营气是行于脉中而具有营养作用的气，营气性质精纯（C错）。中气是脾胃中焦之气，为后天之本（D错）。元气，是人体、最根本最重要的气。是人体生命活动的原动力（E错）。